抑制细菌叶酸合成
A. 头孢米诺
B. 磺胺甲噁唑甲氧苄啶
C. 利福喷丁
D. 头孢吡肟
E. 依替米星

正确答案：B。磺胺甲噁唑甲氧苄啶

解析：本题考查磺胺甲噁唑甲氧苄啶。磺胺甲噁唑甲氧苄啶（B对）可抑制细菌二氢叶酸的合成。磺胺甲噁唑与对氨基苯甲酸（PABA）竞争二氢叶酸合成酶，阻止细菌二氢叶酸的合成。头孢米诺（A错）与细菌细胞内膜上主要的青霉素结合蛋白（PBPs）结合。利福喷丁（C错）可抑制细菌核酸合成。头孢吡肟（D错）抑制细菌细胞壁合成。依替米星（E错）抑制细菌蛋白质的合成。